不属于原发性骨内鳞状细胞癌X线表现的是
A. 牙周骨质破坏
B. 不伴有病理性骨折
C. 牙齿浮立于软组织中
D. 边缘凹凸不平呈虫蚀状
E. 病变进展则可侵犯密质骨

正确答案：B。不伴有病理性骨折

解析：本题考查原发性骨内鳞状细胞癌X线表现。不属于原发性骨内鳞状细胞癌X线表现的是不伴有病理性骨折（B错，为本题正确答案）。原发性骨内鳞状细胞癌：是来源于牙源性上皮剩余的颌骨中央性癌。颌骨为全身骨骼系统内唯一能发生原发性上皮癌的骨骼。X线表现为颌骨内低密度溶骨性破坏，边缘凹凸不平呈虫蚀状（D对），病变向牙槽侧扩展时可使牙周骨质破坏（A对），牙齿浮立于软组织中（C对）。病变继续进展则可侵犯密质骨（E对），晚期可伴病理性骨折。原发性骨内鳞状细胞癌的内部和边缘一般无新骨反应性增生和死骨形成，此为与牙源性颌骨骨髓炎的鉴别要点。